鉴别木质化细胞壁的试液是
A. 钌红试液
B. 氯化锌碘试液
C. 三氯化铁试液
D. α-萘酚试液
E. 间苯三酚试液和盐酸

正确答案：E。间苯三酚试液和盐酸

解析：本题考查的是细胞壁性质检查。鉴别木质化细胞壁的试液是间苯三酚试液和盐酸（E对）。细胞内含物的鉴定及细胞壁性质检查：1.细胞内含物的鉴定：①淀粉粒：加碘试液，显蓝色或紫色；用醋酸甘油试液装片，置偏光显微镜观察，未糊化淀粉粒有偏光现象；已糊化的无偏光现象。②糊粉粒：加碘试液，显棕色或黄棕色；加硝酸汞试液显砖红色。③脂肪油、挥发油或树脂：加苏丹Ⅲ试液呈橘红色、红色或紫红色；加90%乙醇，脂肪油不溶解，挥发油则溶解。④菊糖：加10%α-萘酚乙醇溶液（D错），再加硫酸，呈紫红色并很快溶解。⑤黏液：加钌红试液（A错），显红色。⑥草酸钙结晶：加稀醋酸不溶解，加稀盐酸溶解而无气泡产生；加硫酸溶液（1→2），逐渐溶解，片刻后析出针状硫酸钙结晶。⑦碳酸钙结晶（钟乳体）：加稀盐酸溶解，同时有气泡产生。⑧硅质：加硫酸不溶解。2.细胞壁性质检查：①木质化细胞壁：加间苯三酚试液1～2滴，稍放置，加盐酸1滴，因木化程度不同，显红色或紫红色。②木栓化或角质化细胞壁：加苏丹Ⅲ试液，稍放置或微热，呈橘红色至红色。③纤维素细胞壁：加氯化锌碘试液（B错），或先加碘试液润湿后，稍放置，再加硫酸溶液（33→50）显蓝色或紫色。④硅质化细胞壁：加硫酸无变化。三氯化铁试液（C错）可用来鉴别具有酚羟基的香豆素类、鞣质等化合物。